某患者有丛林接触史，突然高热，用变形杆菌OXk株做抗原与患者血清进行定量凝集试验，抗体效价为1∶320，该患者可能患何种疾病
A. Q热
B. 伤寒病
C. 流行性斑疹伤寒
D. 恙虫病
E. 地方性斑疹伤寒

正确答案：D。恙虫病